女，43岁。右下腹持续性疼痛5天，伴恶心、呕吐，呕出物为胃内容物。体温38.5℃。体检发现右下腹5cm×5cm大小肿块，触痛明显。此时较合适的处理是
A. 急诊行阑尾切除术
B. 急诊手术脓肿引流
C. 肠道准备后行右半结肠切除术
D. X线钡剂灌肠
E. 暂不手术，保守治疗

正确答案：E。暂不手术，保守治疗

解析：女，43岁（患者为中年女性）。右下腹持续性疼痛5天（考虑阑尾、盲肠等器官疾病），伴恶心、呕吐，呕出物为胃内容物（肠道炎症状，无特异性）。体温38.5℃（考虑为炎症性疾病）。体检发现右下腹5cm×5cm大小肿块，触痛明显（考虑是否为脓肿）。综合患者的病史、症状、体征等，最可能的诊断是阑尾周围脓肿。此时较合适的处理是暂不手术，保守治疗（E对）。病人尚未出现严重腹膜炎症状，一般情况尚可，符合保守治疗的条件，此时较合适的处理是暂不手术，配合药物治疗帮助脓肿吸收，待脓肿消退后再进一步处理。急诊行阑尾切除术（A错）往往会导致脓肿扩散，使腹膜炎症状加重，同时易形成瘘管或粪瘘。急诊手术脓肿引流（B错）一般在保守治疗无效，阑尾周围脓肿扩大，无局限趋势，此时宜先行超声检查，确定切口部位后手术引流（P374）。肠道准备后行右半结肠切除术（C错）常用于治疗阑尾或者右半结肠的恶性肿瘤。X线钡灌肠（D错）是检查方法，并非治疗方法。